维生素D缺乏性佝偻病后遗症期的临床特征是
A. 骨骼畸形
B. 长骨干骺端异常
C. 血磷、钙降低
D. 血碱性磷酸酶升高
E. 易激惹、烦闹、多汗

正确答案：A。骨骼畸形

解析：维生素D缺乏性佝偻病在临床上可分为4期：初期、活动期、恢复期、后遗症期。维生素D缺乏性佝偻病后遗症期，因婴幼儿期严重佝偻病，临床特征可表现为骨骼畸形（A对）。活动期时，X线表现可见骨骺软骨盘增宽，长骨干骺端异常（B错）。初期，多无维生素D缺乏性佝偻病特异症状，多为神经兴奋性增高表现，如易激惹、烦闹、多汗（E错），实验室检查可有血磷、钙降低（C错），血碱性磷酸酶升高（D错）。